根据《2011-2015年》药品电子监管工作规划》正确的是
A. 首先对基本药物实施全品种电子监管
B. 在药品生产、批发环节实现电子监管的基础上，推广到药品和使用环节
C. 首先对医疗用毒性药品实施电子监管，逐步推广到血液制品和疫苗
D. 按照先东部发达地区再向西部渗透的原则实施药品电子监管
E. 采用一步到位方式，对所有的药品实施电子监管

正确答案：B。在药品生产、批发环节实现电子监管的基础上，推广到药品和使用环节

解析：本题考查药品电子监管工作规划。《2011-2020年药品电子监管工作规划》具体目标：①2012-2020年实现药品制剂含进口药品“全品种”电子监管。②在生产企业和批发企业已实现电子监管的基础上，向零售药店、医疗机构等末端流通使用环节延伸流通“全过程”（B对）。③拓展药品电子监管系统的深度应用，充分利用药品电子监管数据，为广大社会公众提供药品信息检索、监管码查询、真伪鉴别等服务。